隔姜灸可用于治疗
A. 寒性呕吐腹痛
B. 哮喘 瘢痕灸
C. 瘰疬
D. 疮疡
E. 小儿脐风

正确答案：A。寒性呕吐腹痛

解析：本题考查各种灸法的适应病症。隔姜灸常用于因寒而致的呕吐、腹痛及风寒痹痛等，有温胃止呕、散寒止痛的作用，姜本身就要止呕的功效（A对）。瘢痕灸常用于治疗哮喘、肺痨、瘰疬等慢性顽疾（BC错）隔附子饼灸常用于治疗命门火衰而致的阳痿、早泄或疮疡久溃不敛（D错）。灯火灸多用于治疗小儿脐风，胃痛等症（E错）。